紧急情况下，医师可以越级使用抗菌药物，限定于几天内补办越级使用手续
A. 1天
B. 3天
C. 5天
D. 7天
E. 9天

正确答案：A。1天

解析：因抢救生命垂危的患者等紧急情况，医师可以越级使用抗菌药物。越级使用抗菌药物应当详细记录用药指征，并应当与24小时内补办越级使用抗菌药物的必要手续。掌握“抗菌药物临床应用、监督及法律责任”知识点。